问卷法是社会医学的重要研究方法之一。问卷是由组问题和相应答案所构成的表格，问卷设计的好坏将影响所收集到的资料的有效性及可信度，从而影响问卷调查的效果。问卷的效度可以从以下哪方面来评价
A. 重复测量效度
B. 复本测量效度
C. 折半测量效度
D. 内容效度
E. 干预前后结果的一致性

正确答案：D。内容效度